中药饮片调配后，必须经过药师复核无误后方可发出，调配复核的内容有
A. 核对处方的药味及剂量数是否相符
B. 复核有无错味、漏味、多味
C. 审查药品质量有无虫蛀，霉变
D. 审查调配处方有无乱代乱用现象
E. 对于需特殊煎煮的药味是否单包并注明用法

正确答案：A、B、C、D、E。核对处方的药味及剂量数是否相符；复核有无错味、漏味、多味；审查药品质量有无虫蛀，霉变；审查调配处方有无乱代乱用现象；对于需特殊煎煮的药味是否单包并注明用法

解析：本题考查的是饮片调配复核内容。中药饮片调配后，必须经过药师复核无误后方可发出，调配复核的内容有核对处方的药味及剂量数是否相符（A对）、复核有无错味、漏味、多味（B对）、审查药品质量有无虫蛀，霉变（C对）、审查调配处方有无乱代乱用现象（D对）与对于需特殊煎煮的药味是否单包并注明用法（E对）。中药饮片调配复核内容：中药饮片调配后，必须经复核后方可发出。核对调配好的药品是否与处方所开药味及剂数相符，有无错味、漏味、多味和掺杂异物，每剂药的剂量误差应小于±5%，必要时要复称。还需审查有无配伍禁忌（十八反、十九畏）、妊娠禁忌药物，毒麻药有无超量。毒性中药、贵细药品的调配是否得当。对于需特殊煎煮或处理的药味如先煎、后下、包煎、烊化、另煎、冲服等是否单包并注明用法。审查药品质量，保证无伪劣饮片，审查有无虫蛀、发霉变质，有无生炙不分或以生代炙，整药、籽药应捣未捣，调配处方有无乱代乱用等现象。